细菌生物学性状最典型的时期是
A. 迟缓期
B. 对数期
C. 减数期
D. 稳定期
E. 衰退期

正确答案：B。对数期

解析：本题考查细菌群体的生长繁殖。细菌生物学性状最典型的时期是对数期（B对）。根据生长曲线，细菌的群体生长繁殖可分为四期，包括迟缓期、对数期、稳定期和衰退期，不包括减数期（C错）。迟缓期（A错）是细菌进入新环境后的短暂适应阶段。稳定期（D错）时由于培养基中营养物质消耗，有害代谢产物积聚，该期细菌繁殖速度渐减，死亡数逐渐增加，两者大致平衡，因此该期的活菌数大致恒定，总的细菌数缓慢增加，细菌形态、染色性和生理性状常有改变。衰退期（E错）时细菌形态显著改变，出现衰退型或菌体自溶，难以辨认；生理代谢活动也趋于停滞。